氟化物可能中毒计量
A. 5.7mg
B. 5mg
C. 2.5mg
D. 10mg
E. 15mg

正确答案：B。5mg

解析：本题考查氟化物的毒性作用。氟化物可能中毒计量5mg（B对）。目前推荐5mgF⁻/kg（B对）的摄入剂量为氟化物(氟离子)的可能中毒剂量(PTD)，这个剂量是很可能引起中毒症状和体征(包括致死)，且应立即进行治疗性干预和住院治疗的最低剂量。